健康促进的核心策略包括
A. 保护环境
B. 职业卫生
C. 倡导、赋权、协调
D. 疾病控制
E. 学校卫生

正确答案：C。倡导、赋权、协调

解析：健康促进的基本策略是倡导、赋权、协调（C对），保护环境（A错）、职业卫生（B错）、疾病控制（D错）、学校卫生（E错）均不是基本策略。